患者，男，63岁，既往患有高血压、2型糖尿病、高脂血症。目前使用硝苯地平控释片、盐酸二甲双胍片、阿卡波糖片、瑞舒伐他汀钙片。新诊断冠心病，给予阿司匹林肠溶片，单硝酸异山梨酯缓释片治疗。该患者入院前使用瑞舒伐他汀钙片5mg进行治疗，但入院后低密度脂蛋白未达标，则应选择的方案是
A. 增加瑞舒伐他汀钙剂量
B. 停用瑞舒伐他汀钙，换用依折麦布
C. 维持现有治疗方案不变
D. 将瑞舒伐他汀钙剂量减半
E. 停用瑞舒伐他汀钙，换用非诺贝特

正确答案：A。增加瑞舒伐他汀钙剂量

解析：本题考查瑞舒伐他汀钙用法用量。瑞舒伐他汀常规治疗时一日5～40mg。初始治疗时应从10mg开始，需要时增至20～40mg，患者低密度脂蛋白未达标，可增加瑞舒伐他汀钙剂量（A对）。